类风湿关节炎属于
A. 内科心身疾病
B. 儿科心身疾病
C. 外科心身疾病
D. 口腔科心身疾病
E. 皮肤科心身疾病

正确答案：C。外科心身疾病

解析：外科心身疾病：全身性肌肉痛、书写痉挛、外伤性神经症、阳痿、类风湿关节炎。掌握“心身疾病”知识点。